峰电位的幅值等于
A. 静息电位与负后电位之和
B. K⁺平衡电位与超射值之和
C. 静息电位绝对值与超射值之和
D. Na⁺平衡电位
E. K⁺的平衡电位

正确答案：C。静息电位绝对值与超射值之和